分析性研究中，暴露的确切含义是
A. 指一个发病因素
B. 指多个危险因素
C. 指研究对象具有某种疑为与患病与否可能有关的特征或曾受到某种疑为与患病与否可能有关的因子的影响
D. 指接触了危险因素

正确答案：C。指研究对象具有某种疑为与患病与否可能有关的特征或曾受到某种疑为与患病与否可能有关的因子的影响

解析：本题考查暴露的概念。暴露是指研究对象接触过某种待研究的物质或具有某种待研究的特征（如年龄、性别及遗传性状等）或行为（C对ABD错）。